患者，男，15岁。正畸需要减数拔牙，术中误将右下尖牙认为第一前磨牙拔除。该种治疗的成功判断标准中，不恰当的是
A. 不松动
B. 疼痛消失，无感染
C. 牙功能正常，牙龈附着正常
D. X线片示牙根无异常透射影
E. 行使功能达2年以上

正确答案：E。行使功能达2年以上

解析：本题考查牙槽外科。再植牙成功的判断标准，一般认为是：疼痛消失，无感染（B对），不松动（A对），牙功能正常，牙龈附着正常（C对）。X线片示牙根无异常透射影（D对）。行使功能达5年以上（E错，为本题正确答案），即为成功。